以下关于修复体粘结力的描述，正确的是
A. 修复体组织面抛光提高粘结力
B. 粘结面积越大粘结力越强
C. 水门汀过稠提高粘结力
D. 水门汀过稀提高粘结力
E. 水门汀厚度越厚粘结力越强

正确答案：B。粘结面积越大粘结力越强

解析：本题考查影响粘接力的因素。以下关于修复体粘结力的描述，正确的是粘结面积越大粘结力越强（B对）。影响粘接力的因素有：1.粘接面积：粘接力与面积成正比。在同样情况下，面积越大，粘接力越强。2.水门汀厚度（E错）：一般来说，水门汀层越厚，其固化收缩越大，对水门汀材料自身强度的影响也越大，因此修复体与预备体的表面之间应尽量密合。3.粘接面粗糙度（A错）：适当的增加粗糙度可以增加粘接力。4.粘接面状况：粘接面应保持清洁，干燥，没有水分、油质、唾液等污染。对修复体粘接面采用喷砂、酸蚀等方法进行处理，能有效地改善材料的表面性状。5.水门汀调拌的稠度应适当（CD错）：水门汀过稀或过稠均影响粘接力。6.水门汀的种类：不同类型的水门汀对界面之间的粘接力产生不同的效果，选择合适的水门汀受多因素的影响。一般而言，玻璃离子水门汀能获得较强的固位力，但其机械性能，如抗压强度不如磷酸锌水门汀。近年来树脂粘接材料和技术发展很快，在临床上被越来越多地应用。7.修复材料种类及特性：金属和陶瓷是临床上最常用的两种修复材料。